《中国药典》以苦杏仁苷为质量控制成分的是
A. 山豆根
B. 苦杏仁
C. 桃仁
D. 防己
E. 郁李仁

正确答案：B、C、E。苦杏仁；桃仁；郁李仁

解析：本题考查的是苦杏仁、桃仁与郁李仁的质量控制成分。《中国药典》以苦杏仁苷为质量控制成分的是苦杏仁（B对）、桃仁（C对）与郁李仁（E对）。苦杏仁主要含苦杏仁苷，《中国药典》以苦杏仁苷为指标成分进行含量测定，规定含量不低于3.0%。桃仁中的主要化学成分为脂溶性物质、蛋白质、甾醇及其糖苷类、黄酮类、酚酸类等，其中脂溶性成分占桃仁干质量的50%，蛋白质占25%；桃仁含有氰苷化合物，其中苦杏仁苷的量为1.5%～3.0%，《中国药典》以苦杏仁苷为指标成分进行含量测定，规定苦杏仁苷含量不得少于2.0%。郁李仁主要化学成分为郁李仁苷A、郁李仁苷B、苦杏仁苷、香草酸、原儿茶酸、熊果酸以及黄酮类化合物阿福豆苷、山柰苷等，《中国药典》以苦杏仁苷为指标成分进行含量测定，规定苦杏仁苷含量不得少于2.0%。山豆根（A错）的主要活性成分为生物碱，这些生物碱大多属于喹喏里西啶类。其中以苦参碱和氧化苦参碱为主，《中国药典》以苦参碱和氧化苦参碱为指标成分进行含量测定要求药材两者总量不得少于0.70%，饮片两者总量不得少于0.60%。防己（D错）的有效成分为生物碱，总生物碱含量可达2.3%～5%，其中汉防己甲素（粉防己碱），约为1%，汉防己乙素（防己诺林碱）约为0.5%。《中国药典》以粉防己碱和防己诺林碱为指标成分进行含量测定，对药材要求两者总量不得少于1.6%；对饮片要求两者总量不得少于1.4%。